关于细菌性肝脓肿的临床表现错误的是
A. 肝肿大并有触压痛
B. 寒战、高热
C. 肝区胀痛
D. 胆囊肿大
E. 起病急

正确答案：D。胆囊肿大

解析：细菌性肝脓肿较少累及胆囊，一般不会出现胆囊肿大（D错，为本题正确答案）。由于脓肿的存在会使肝肿大，脓肿移行肝表面导致触压痛（A对），肝大牵引肝被膜急性膨胀，引起肝区胀痛（C对）。细菌性肝脓肿属于细菌感染引起的炎症，起病急（E对），有寒战高热（B对）。